中龋达到牙本质浅层，即龋洞已经形成，但是在主观症状不明显，龋洞所在牙面不承受咬合力情况下，可以使用下列哪项材料
A. 银汞合金充填体
B. 玻璃离子体
C. 磷酸锌糊剂
D. 氢氧化钙糊剂
E. 氧化锌丁香油酚糊剂

正确答案：B。玻璃离子体

解析：本题考查龋病的治疗原则与非手术治疗方法。玻璃离子体（B对）的适应症包括：根面龋的修复、后牙邻面单面洞等不承担咀嚼压力的窝洞，不考虑美观因素的Ⅲ类洞、Ⅴ类洞和乳牙的各类洞的修复。